审查机关对广告制作前文稿的真实性、合法性进行审查为
A. 药品广告初审
B. 药品广告终审
C. 药品广告复审
D. 撤销药品广告审查批准文号
E. 重新申请审查

正确答案：A。药品广告初审

解析：本题考查药品广告审查。审查机关对广告制作前文稿的真实性、合法性进行审查为药品广告初审（A对）。药品广告审查机关应当自受理之日起10个工作日内，对申请人的提交的证明文件的真实性、合法性、有效性进行审查。